维生素B₂的特定吸收部位在小肠上部，故其最适宜服用的时间是
A. 清晨
B. 餐前
C. 餐中
D. 餐后
E. 睡前

正确答案：D。餐后

解析：本题考查药物的适宜服用时间。维生素B₂的特定吸收部位在小肠上部，故其最适宜服用的时间是餐后（D对）。不同的药物服用时间会影响药物在人体内的吸收过程，维生素B₂的特定吸收部位在小肠上部，饭后服用在胃内停留时间长，吸收更完全。